《素问·调经论》说“血有余”，则
A. 怒
B. 喜
C. 思
D. 悲
E. 恐

正确答案：A。怒

解析：怒以肝之气血为生理基础，肝之气血失调常可引起怒志的异常改变。血有余则怒（A对），不足则恐（E错）。